关于肱骨结构特点的描述，错误的是
A. 可分为一体两端
B. 解剖颈处较易骨折
C. 有桡神经沟
D. 外科颈处较易骨折
E. 有尺神经沟

正确答案：B。解剖颈处较易骨折

解析：肱骨分为肱骨体及上、下两端（A对）。肱骨体后面中部可见自内上斜向外下的浅沟，称桡神经沟（C对），肱骨内上髁后方的浅沟称尺神经沟（E对）。肱骨上端与体交界处稍细，称外科颈较易发生骨折（B错,为本题正确答案）。